用吸收系数法测定药物的含量时，计算公式C（浓度）=A/E1%1cml中符号E1%1cm代表的是
A. 透光率
B. 波长
C. 吸光度
D. 吸收系数
E. 液层厚度

正确答案：D。吸收系数

解析：本题考查吸收系数法。用吸收系数法测定药物的含量时，计算公式C（浓度）=AE1%1cml中符号E1%1cm代表的是吸收系数（D对）。A为吸光度（C错）；T为透光率（A错）；E为吸收系数，采用的表示方法是（E1%1cm），其物理意义为当溶液浓度为1%（g/ml），液层厚度为1cm时的吸收度数值；C为100ml溶液中所含被测物质的重量（按干燥品或无水物计算），g；L为液层厚度（E错），cm。波长（B错）不是变量。